包衣的目的有
A. 控制药物在胃肠道中的释放部位
B. 控制药物在胃肠道中的释放速度
C. 掩盖药物的苦味
D. 防潮、避光、增加药物的稳定性
E. 改善片剂的外观

正确答案：A、B、C、D、E。控制药物在胃肠道中的释放部位；控制药物在胃肠道中的释放速度；掩盖药物的苦味；防潮、避光、增加药物的稳定性；改善片剂的外观

解析：本题考查片剂的包衣。片剂包衣的主要目的如下：①掩盖药物的苦味（C对）或不良气味，改善药物顺应性，方便服用；②防潮、避光，以增加药物的稳定性（D对）；③可用于隔离药物，避免药物间的配伍变化；④改善片剂的外观（E对），提高流动性和美观度；⑤控制药物在胃肠道的释放部位（A对）和释放速度（B对），实现胃溶、肠溶或缓控释等目的。